拔牙术引发细菌性心内膜炎的致病菌是
A. 金黄色葡萄球菌
B. 大肠杆菌
C. 甲型溶血性链球菌
D. 乙型溶血性链球菌
E. 肺炎球菌

正确答案：C。甲型溶血性链球菌

解析：本题考查拔牙术引发细菌性心内膜炎的致病菌。拔牙、口腔某些治疗和手术，可引起一过性的菌血症，风湿性心脏病和其他获得性瓣膜功能不全、多数先天性心脏畸形、人工心脏瓣膜和瓣膜手术后、有细菌性心内膜炎病病史者可能会由此导致细菌性心内膜炎的发生，其中引起此病的重要因素之一是绿色链球菌（甲型溶血性链球菌）（C对）菌血症，此细菌对青霉素高度敏感。金黄色葡萄球菌（A错）是人类化脓感染中最常见的病原菌，可引起局部化脓感染，也可引起肺炎、伪膜性肠炎、心包炎等，甚至败血症、脓毒症等全身感染。大肠杆菌（B错）可引起急性腹泻、肠道感染等疾病。乙型溶血性链球菌（D错）常可引起皮肤、皮下组织的化脓性炎症、呼吸道感染、以及新生儿败血症、猩红热和风湿热、肾小球肾炎等变态反应。肺炎球菌（E错）可引发肺部炎症。